扣除了死亡、残疾和疾病对于健康的影响，衡量的是
A. 减寿人年数
B. 无残疾期望寿命
C. 活动期望寿命
D. 伤残调整生命年
E. 健康期望寿命

正确答案：E。健康期望寿命